女，36岁。颈前包块10年，心慌、气短、怕热、多汗半年。查体：P110次/分，BP160/70mmHg，无突眼，甲状腺触及多个结节，中等硬度，表面光滑，随吞咽可上下移动。实验室检查T₃、T₄增高，TSH降低，TPOAb及TGAb均阴性。最可能的诊断是
A. 单纯性甲状腺肿
B. 结节性毒性甲状腺肿
C. 慢性淋巴细胞性甲状腺炎
D. 甲状腺自主高功能腺瘤
E. 弥漫性毒性甲状腺肿

正确答案：B。结节性毒性甲状腺肿

解析：中青年女性患者，颈前包块10年（提示甲状腺长期肿大），心慌、气短、怕热、多汗半年（甲亢的典型临床表现，提示甲状腺毒症）。查体：P110次/分（脉率增快，正常值60～100次/分），BP160/70mmHg（脉压增大，正常值约30～40mmHg），无突眼（提示原发性甲亢可能性低），甲状腺触及多个结节，中等硬度，表面光滑，随吞咽可上下移动（提示存在甲状腺结节）。实验室检查：T3、T4增高，TSH降低（甲亢的典型实验室检查结果），TPOAb及TGAb均阴性（提示原发性甲亢可能性低）。综合该患者的病史、体查及实验室检查，最可能的诊断是结节性毒性甲状腺肿（B对）。单纯性甲状腺肿（P226）（A错）甲状腺功能正常，一般无甲亢的临床症状。慢性淋巴细胞性甲状腺炎（P231）（C错）甲状腺多呈弥漫性对称肿大，质硬光滑，多伴有甲状腺功能减退，且血清中TPOAb（甲状腺过氧化物酶抗体）及TGAb（甲状腺球蛋白抗体）多阳性。甲状腺自主高功能腺瘤（P228）（D错）多为颈部单发椭圆形或圆形结节而非多发结节，且结节周围甲状腺组织呈萎缩改变。弥漫性毒性甲状腺肿（P228）（E错）甲状腺多呈弥漫性对称肿大，常伴有眼球突出，50%～90%患者TPOAb及TGAb呈阳性。